正确的是
A. 只位于长骨的骨髓腔内
B. 黄骨髓有造血功能
C. 黄骨髓不能转化为红骨髓
D. 胎儿和幼儿骨内完全是红骨髓
E. 红骨髓无造血功能

正确答案：D。胎儿和幼儿骨内完全是红骨髓

解析：红骨髓含有不同发育阶段的红细胞和其他幼稚型血细胞，呈红色，有造血和免疫功能（E错）。胎儿和幼儿的骨髓均为红骨髓， 5 岁以后，长骨骨干内的红骨髓逐渐被脂肪组织代替（C错），呈黄色，称黄骨髓,失去造血能力（D对）。椎骨、骼骨、肋骨、胸骨以及肱骨和股骨等长骨的骺内终生存在红骨髓（A错）。